磺胺类药物的抗菌机制是
A. 抑制二氢叶酸合成酶
B. 改变细菌细胞膜通透性
D. 抑制二氢叶酸还原酶
E. 抑制细菌DNA螺旋酶

正确答案：A。抑制二氢叶酸合成酶